计划在某市开展人群健康状况的抽样调查，以下参数不会影响样本量大小的是
A. 该市人群预期健康状况的患病率
B. 对调查结果精确性的要求
C. 健康指标的标准差
D. α
E. 1-β

正确答案：E。1-β